通常前牙金属烤瓷冠唇侧龈边缘的最佳选择是
A. 龈上凹形边缘
B. 龈下肩台边缘
C. 龈上肩台边缘
D. 龈下凹形边缘
E. 平龈边缘

正确答案：B。龈下肩台边缘

解析：本题考查前牙金属烤瓷冠唇侧龈边缘的设计。通常前牙金属烤瓷冠唇侧龈边缘的最佳选择是龈下肩台边缘（B对）。前牙修复强调美观，要设计龈下边缘（ACE错）；凹形（凹槽）边缘（D错）肩台宽度为0.5mm，空间不足以容纳金属加烤瓷；深凹槽和肩台边缘宽度为1mm，可以满足这个条件。